不属于上腔静脉收集范围的是
A. 颅内
B. 心
C. 甲状腺
D. 胸壁深层
E. 上肢浅层

正确答案：B。心

解析：颅内（A对）、甲状腺（C对）、胸壁深层（D对）、上肢浅层（E对）均为上腔静脉的收集范围。心（B错，为本题正确答案）由心的静脉收集。